冠状动脉粥样硬化心脏病的患者，如没有用药禁忌症，欲服用阿司匹林作为一级预防，最佳剂量范围是
A. 25～50mg/d
B. 25～75mg/d
C. 75～150mg/d
D. 150～300mg/d
E. 300～500mg/d

正确答案：C。75～150mg/d

解析：本题考查阿司匹林的使用。75～150mg/d（C对）是阿司匹林作为一级预防冠状动脉粥样硬化心脏病（没有用药禁忌症患者）的最佳剂量范围。